男婴，8个月。腹泻伴呕吐3天，无尿6小时。大便10～15次/天，呈蛋花汤样伴黏液，有腥臭味。查体：T37.8℃，表情淡漠，前囟、眼窝明显凹陷，皮肤弹性差，可见花纹，四肢厥冷，双肺呼吸音清，心率120次/分，腹软，无明显压痛。实验室检查：粪镜检偶见白细胞，血钠134mmol/L。首批快速扩容静脉输液应绐予
A. 1/3张含钠液
B. 2：1等张含钠液
C. 2/3张含钠液
D. 1/2张含钠液
E. 4/5张含钠液

正确答案：B。2：1等张含钠液

解析：患儿腹泻伴呕吐，大便10～15次/天，呈蛋花汤样伴黏液，有腥臭味（产毒性大肠埃希菌肠炎的临床表现）。无尿6小时，表情淡漠，前囟、眼窝明显凹陷，皮肤弹性差，可见花纹，四肢厥冷（重度脱水表现），血钠134mmol/L（正常值135～145mmol/L，为等渗性脱水）。根据患者的病史、临床表现和实验室检查，最可能的诊断是产毒性大肠埃希菌肠炎。重度缺水时第一阶段补液应补2：1等张含钠液或生理盐水（B对）。1/2张含钠液（D错）为重度等渗缺水第二阶段的补液方案。1/3张含钠液（A错）为重度高渗性脱水第二阶段的补液方案。2/3张含钠液（C错）为重度低渗性脱水第二阶段的补液方案。